男性，22岁。水样腹泻1天，粪便呈淘米水样，每次约500ml，共大便10余次，无腹痛，口渴，腓肠肌痉孪，粪检少许红白细胞，腹泻的原因可能为
A. 胃泌素瘤
B. 甲状腺功能亢进
C. 霍乱
D. 吸收不良综合征
E. 急性胃肠炎

正确答案：C。霍乱